果实表面棕红色或红黄色，具有6条翅状纵棱的药材是
A. 蛇床子
B. 地肤子
C. 枸杞子
D. 栀子
E. 女贞子

正确答案：D。栀子

解析：本题考查的是栀子的性状鉴别。果实表面棕红色或红黄色，具有6条翅状纵棱的药材是栀子（D对）。栀子【性状鉴别】药材呈长卵圆形或椭圆形，长1.5～3.5cm，直径1～1.5cm。表面红黄色或棕红色，具6条翅状纵棱，棱间常有1条明显的纵脉纹，并有分枝。顶端残存萼片，基部稍尖，有残留果梗。果皮薄而脆，略有光泽；内表面色较浅，有光泽，具2～3条隆起的假隔膜。种子多数，扁卵圆形，集结成团，深红色或红黄色，表面密具细小疣状突起。蛇床子（A错）【性状鉴别】药材为双悬果，呈椭圆形，长2～4mm，直径约2mm。表面灰黄色或灰褐色，顶端有2枚向外弯曲的柱基，基部偶有细梗。分果的背面有薄而突起的纵棱5条，接合面平坦，有2条棕色略突起的纵棱线。地肤子（B错）【性状鉴别】药材呈扁球状五角星形，直径0.1～0.3cm。外被宿存花被，表面灰绿色或浅棕色，周围具膜质小翅5枚，背面中心有微突起的点状果梗痕及放射状脉纹5～10条；剥离花被，可见膜质果皮，半透明。枸杞子（C错）【性状鉴别】药材呈类纺锤形或椭圆形，长6～20mm，直径3～10mm。表面红色或暗红色，顶端有小突起状的花柱痕，基部有白色的果梗痕。女贞子（E错）【性状鉴别】药材呈卵形、椭圆形或肾形，长6～8.5mm，直径3.5～5.5mm。表面黑紫色或灰黑色，皱缩不平，基部有果梗痕或具宿萼及短梗。